紫珠叶的功效有
A. 收敛止血
B. 补阴止血
C. 化瘀止血
D. 温经止血
E. 清热解毒

正确答案：A、E。收敛止血；清热解毒

解析：本题考查的是紫珠叶的性能特点与功效。紫珠的功效有收敛止血（A对）与清热解毒（E对）。紫珠叶：【性能特点】本品苦凉清泄，味涩收敛，入肝、肺、胃经。既凉血、收敛而止血，又清热解毒而疗疮。治血热出血，属肺胃蕴热者尤佳；治烧伤与疮疡，外用内服皆善。【功效】收敛凉血止血，散瘀解毒消肿。阿胶：【功效】补血止血（B错），滋阴润燥。景天三七：【功效】化瘀止血（C错），宁心安神，解毒。炮姜：【功效】温经止血（D错），温中止痛。